下列抗结核药物中哪项不属于杀菌剂
A. 利福平
B. 异烟肼
C. 链霉素
D. 吡嗪酰胺
E. 对氨基酸水杨酸

正确答案：E。对氨基酸水杨酸

解析：本题考查抗结核药物。根据药物浓度的不同分为全杀菌剂、半杀菌剂和抑菌剂。1.全杀菌剂是指抗结核药物浓度在细胞内外均能达到杀菌水平，包括异烟肼（B对）和利福平（A对）。2.半杀菌剂是指抗结核药物浓度仅在细胞内或细胞外能达到杀菌水平，如链霉素（是对细胞外结核杆菌）（C对），吡嗪酰胺（是对细胞内结核杆菌）（D对）。3.抑菌剂是指在细胞内外均未能达到杀菌水平的抗结核药物，包括乙胺丁醇、对氨基水杨酸钠（E错，为本题正确答案）等。